独活具有的功效是
A. 活血
B. 行气
C. 化痰
D. 泻下
E. 解表

正确答案：E。解表

解析：该题考查的是独活的功效，属记忆内容。独活功效 祛风湿，止痛，解表（E对）。